按照《中华人民共和国药品管理法》，下列情形中按假药论处的是
A. 未标明有效期的药品
B. 更改生产批号的药品
C. 擅自添加防腐剂的药品
D. 超过有效期的药品
E. 变质的药品

正确答案：E。变质的药品

解析：本题考查假药。按假药论处的是变质的药品（E对）。《药品管理法》第四十八条规定，禁止生产、销售假药。有下列情形之一的，为假药：①药品所含成份与国家药品标准规定的成份不符的；②以非药品冒充药品或者以他种药品冒充此种药品的。有下列情形之一的药品，按假药论处：①国务院药品监督管理部门规定禁止使用的；②依照本法必须批准而未经批准生产、进口，或者依照本法必须检验而未经检验即销售的；③变质的；④被污染的；⑤使用依照本法必须取得批准文号而未取得批准文号的原料药生产的；⑥所标明的适应症或者功能主治超出规定范围的。未标明有效期的药品（A错）、更改生产批号的药品（B错）、擅自添加防腐剂的药品（C错）、超过有效期的药品（D错）均按劣药论处。